硫酸锌滴眼剂中加入少量硼酸的目的是
A. 降低介电常数使注射液稳定
B. 防止药物水解
C. 防止药物氧化
D. 降低离子强度使药物稳定
E. 防止药物聚合

正确答案：B。防止药物水解

解析：本题考查药物的配伍变化。硫酸锌滴眼剂中加入少量硼酸的目的是防止药物水解（B对）。硫酸锌滴眼剂中，常加入少量的硼酸使溶液呈弱酸性，其作用是防止硫酸锌水解。巴比妥钠注射剂中加有60%丙二醇的目的是降低溶剂介电常数，使注射液稳定（A错）。维生素A制成β-环糊精包合物的目的是因为维生素A容易氧化，制成包合物提高药物的稳定性（C错）。在制剂处方中，往往加入电解质调节等渗，或加入盐防止氧化，加入缓冲剂调节pH，因而存在离子强度对降解速度的影响，硫酸锌滴眼剂中加入少量硼酸并没有降低离子强度（D错）。药物聚合会使药物的稳定性降低而降低疗效，硫酸锌滴眼剂中加入少量硼酸并不是以防止药物聚合为目的（E错）。